动物体内嘧啶代谢的终产物不包括
A. NH₃
B. CO₂
C. 尿酸
D. β-丙氨酸
E. β-氨基异丁酸

正确答案：C。尿酸